雷头风的治疗，应首选
A. 桑菊饮
B. 清震汤
C. 川芎茶调散
D. 芎芷石膏汤
E. 黄连上清丸

正确答案：B。清震汤

解析：雷头风以头中如雷鸣，头面起核为特征。《赤水玄珠•头痛门》：“夫此病未有不因于痰火者，盖痰生热，热生风故也。核块疙瘩皆有形可征，痰火上升，壅于气道，兼于风化，则自然有声，轻则或如蝉之鸣，重则或如雷之响，故以声如雷而为名也”，其治法为疏利少阳，清热利湿解毒，代表方为淸震汤（B对）。桑菊饮，其功用为疏风清热，宣肺止咳，可用于咳嗽之风热犯肺证(A错)。川芎茶调散，其功用为疏风散寒止痛，用于外感头痛之风寒头痛证（C错）。芎芷石膏汤，其功用为清热散风止痛，可用于外感头痛之风热头痛证（D错）。黄连上清丸，其功用为泄热通腑，用于风热头痛证伴大便秘结，腑气不通，口舌生疮者（E错）。